我国《化妆品卫生标准》中，对化妆品中有毒物质有限量要求的不包括
A. 汞
B. 铅
C. 铬
D. 甲醇
E. 砷

正确答案：C。铬